中药方剂有因剂型改变而方名改变者，如传统方理中丸与人参汤两方均由干姜、白术、人参、甘草组成用量完全相同。前者制法是共为细末炼蜜为丸如鸡子黄大；后者为汤剂。通常临床所见疾病往往复杂多变，可谓病有缓急证有表里，同一中药处方可因剂型不同，作用有所差异。应根据病情的不同，选择不同的剂型给药。人参汤主治病证与病势不包括
A. 心胸痞闷
B. 四肢不温
C. 病势较缓
D. 气从胁下上逆抢心
E. 中上二焦虚寒之胸痹

正确答案：C。病势较缓

解析：本题考查的是方剂的组方变化。人参汤主治病势较急（C错，为本题正确答案）。方剂的剂型更换变化：中药制剂种类较多，各有特点。同一方剂，由于配制的剂型不同，其作用也就不同。但这种差异只是药力大小与峻缓的区别，在主治病情上有轻重缓急之分而已。如抵挡汤与抵挡丸，方药相同，前者是汤剂，主治下焦蓄血之重症，其人发狂或如狂，少腹鞕满，小便自利；后者用丸剂，主治下焦蓄血之轻症，只见身热，少腹满，小便自利。又如理中丸与人参汤，两方组成与用量（干姜、白术、人参、甘草各三两）完全相同，前者共为细末，炼蜜为丸如鸡子黄大，治中焦虚寒，脘腹疼痛，自利不渴，或病后喜睡等；后者为汤剂，主治中上二焦虚寒之胸痹（E对），症见心胸痞闷（A对），气从胁下上逆抢心（D对），四肢不温（B对），少气懒言等。前者虚寒较轻，病势较缓，取丸以缓治；后者虚寒较重，病势较急，取汤以速治。